以下哪项不是结核病流行的影响因素
A. 年龄
B. 生活水平
C. 人口流动
D. 环境潮湿
E. 劳动强度大

正确答案：A。年龄